女性，55岁，一小时前服用农药“乐果”，半小时后出现腹痛，恶心，呕吐，昏迷，呼吸呕吐有大蒜味，还有的表现为
A. 骨骼肌震颤
B. 瞳孔扩大
C. 出汗减少
D. 气道分泌物减少
E. 唾液分泌减少

正确答案：A。骨骼肌震颤

解析：中毒时，眼和呼吸道症状可首先出现，表现为瞳孔明显缩小（B错）、眼球疼痛、结膜充血、睫状肌痉挛、 视物模糊；也可见泪腺、鼻腔腺体、唾液腺（E错）、支气管（D错）和胃肠道腺体分泌增加；呼吸系统症状还包括胸腔紧缩感，由于支气管平滑肌收缩、呼吸道腺体分泌增加所致的呼吸困难，当毒物由胃肠道摄入时，则胃肠道症状可首先出现，表现为厌食、恶心、呕吐 、腹痛、 腹泻等当毒物经皮肤吸收时，首先可见与吸收部位最邻近区域的出汗（C错）及肌束颤动（A对）。